一腹泻婴儿体重9kg。中度脱水，该患儿体液丢失量约为
A. 1200ml
B. 800ml
C. 400ml
D. 200ml
E. 100ml

正确答案：B。800ml

解析：中度脱水，失水量为体重的5%～10%（50～100ml/kg），该患儿体重为9kg，该患儿体液丢失量约为450～900ml。掌握“儿童营养基础”知识点。